参与过敏性支气管哮喘发病的细胞中，不常见的是
A. 肥大细胞
B. T淋巴细胞
C. 中性粒细胞
D. 支气管黏膜上皮细胞
E. 嗜酸性粒细胞

正确答案：C。中性粒细胞